某女，55岁，患2型糖尿病，症见多饮，多食，多尿。证属阴虚内热，宜选用的中成药是
A. 消渴丸
B. 玉泉丸
C. 青蛾丸
D. 济生肾气丸
E. 人参养荣丸

正确答案：B。玉泉丸

解析：本题考查的是玉泉丸的主治。患2型糖尿病，症见多饮，多食，多尿。证属阴虚内热，宜选用的中成药是玉泉丸（B对）。玉泉丸：【主治】阴虚内热所致的消渴，症见多饮、多食、多尿；2型糖尿病见上述证候者。消渴丸（A错）：【主治】气阴两虚所致的消渴病，症见多饮、多尿、多食、消瘦、体倦乏力、眠差、腰痛；2型糖尿病见上述证候者。青蛾丸（C错）：【主治】肾虚腰痛，起坐不利，膝软乏力。济生肾气丸（D错）：【主治】肾阳不足、水湿内停所致的肾虚水肿、腰膝酸重、小便不利、痰饮咳喘。人参养荣丸（E错）：【主治】心脾不足，气血两亏，形瘦神疲，食少便溏，病后虚弱。